以生殖细胞染色体畸变为检测终点的试验方法是
A. 微核试验
B. 彗星试验
C. 果蝇伴性隐性致死试验
D. 姐妹染色单体交换试验
E. 显性致死试验

正确答案：E。显性致死试验